具有水溶性的生物碱是
A. 小檗碱
B. N-甲基金雀花碱
C. 川芎嗪
D. 新番木鳖碱
E. 秋水仙碱

正确答案：E。秋水仙碱

解析：本题考查的是生物碱的理化性质。具有水溶性的生物碱是秋水仙碱（E对）。酰胺类生物碱：由于酰胺在水中可形成氢键，所以在水中有一定的溶解度，如秋水仙碱、咖啡碱。少数液体生物碱及小分子固体生物碱如麻黄碱、烟碱等具挥发性。极少数生物碱还具有升华性，如咖啡因、川芎嗪（C错）等。